男，45岁。乏力、双下肢水肿2年。母亲及哥哥患有乙型肝炎多年。查体：T36.5℃，P80次/分。R18次/分，BP120/80mmHg。前胸可见数个蜘蛛痣，可见肝掌，双肺呼吸音清，未闻及干湿性啰音，心率80次/分，心律齐，未闻及杂音，腹软，肝肋下未触及，脾肋下5cm。血Alb28g/U如果该患者行肝穿穿刺活组织病理检查，最可能存在的特征性肝脏组织学病理改变的是
A. 肝细胞桥接坏死
B. 肝细胞脂肪样变
C. 肝细胞碎片状坏死
D. 肝细胞气球样变
E. 假小叶形成

正确答案：E。假小叶形成

解析：45岁男性患者，乏力、双下肢水肿2年。母亲及哥哥患有乙型肝炎患者（乙肝家族史）；查体：前胸可见数个蜘蛛痣，可见肝掌，肝肋下未触及（肝硬化失代偿期表现），脾肋下5cm（脾大）。实验室检查：血Alb28g/L（成人正常参考值：40～55g/L，＜25g/L提示低白蛋白血症）。根据临床表现、病史和查体，应诊断为肝硬化失代偿期。假小叶（E对）是由纤维间隔包绕再生结节或将残留肝小叶重新分割形成，是肝硬化特征性病理表现。肝细胞桥接坏死（A错）、肝细胞碎片状坏死（C错）、肝细胞气球样变（D错）可见于肝炎、肝硬化及多种肝脏疾病中，不具有典型代表性。